下列各项，不属标准预防技术的是
A. 洗手
B. 戴手套
C. 穿隔离衣
D. 戴防护眼罩
E. 病房的空气处理系统

正确答案：E。病房的空气处理系统

解析：标准预防的措施：（1）手卫生：洗手和手消毒（A对）。（2）使用个人防护用品：在预期可能接触到血液、体液、分泌物、排泄物或其他潜在传染性物质时，正确的使用个人防护用品。包括手套（B对）、口罩、防护面罩（D对）、护目镜、隔离衣（C对）、防护用品、帽子、鞋等。（3）呼吸卫生/咳嗽礼仪：主要针对进入医疗机构的伴有呼吸道感染征象的所有人员，尽早采取感染控制措施，预防呼吸道传染性疾病的传播。（4）正确安置及运送患者，防止感染原传播。（5）及时、正确的处理污染的医疗器械、器具、织物和环境，防止其成为感染原的传播媒介。（6）安全注射：对接受注射者无害；实施注射操作的医务人员不暴露于可避免的危险中；注射的废弃物不对他人造成危害。